基底细胞腺瘤最常发生于
A. 下颌下腺
B. 腮腺
C. 唇腺
D. 舌下腺
E. 腭腺

正确答案：B。腮腺

解析：基底细胞腺瘤约75%发生于腮腺，5%发生于下颌下腺。掌握“基底细胞腺瘤及恶性多形性腺瘤”知识点。